与乌头相反的药物是
A. 半夏
B. 甘草
C. 细辛
D. 白芍
E. 五灵脂

正确答案：A。半夏

解析：乌头（包括川乌、草乌、附子）反浙贝母、川贝母、瓜蒌、天花粉、半夏（A对）、白及、白蔹；甘草（B错）反海藻、京大戟、红大戟、甘遂、芫花；藜芦反人参、西洋参、党参、丹参、玄参、北沙参、南沙参、苦参、细辛（C错）、白芍（D错）、赤芍。五灵脂（E错）畏人参。